有关掌浅弓、掌深弓的描述，错误的是
A. 掌浅弓位于掌腱膜深面
B. 掌浅弓位于掌深弓远侧
C. 掌深弓发出指掌侧总动脉到达手指
D. 2个弓之间有分支互相连通
E. 掌深弓在屈指肌腱的深面

正确答案：C。掌深弓发出指掌侧总动脉到达手指

解析：掌浅弓位于掌腱膜深面（A对）、位于掌深弓远侧（B对）。掌浅弓（C错，为本题正确答案）发出指掌侧总动脉到达手指。2个弓之间有分支互相连通（D对）。掌深弓在屈指肌腱的深面（E对）。